女，50岁。间断腹泻10年，大便3～5次/日，黄稀便，无脓血。最可能的诊断是
A. 肠易激综合征
B. 克罗恩病
C. 溃疡性结肠炎
D. 肠结核
E. 阿米巴痢疾

正确答案：A。肠易激综合征

解析：中老年女性患者，间断腹泻10年（病程6个月以上），大便3～5次/日（排便频率异常），稀便（粪便性状异常），无脓血（肠易激综合征患者粪便绝无脓血），考虑诊断为肠易激综合征（A对）。克罗恩病（P377）（B错）临床以腹痛、腹泻、体重下降、腹块、瘘管形成和肠梗阻为特点。溃疡性结肠炎（P374）（C错）的典型表现为反复发作的腹泻、腹痛和黏液脓血便。肠结核（P368）（D错）多出现发热、盗汗等结核毒血症状。阿米巴痢疾（E错）有阿米巴病史，表现为黏液血便，有腥臭。